反式己烯雌酚与雌二醇具有相同的生物活性，而顺式己烯雌酚没有此活性。产生这种差异的原因是
A. 构象异构
B. 几何异构
C. 构型异构
D. 组成差异
E. 代谢差异

正确答案：B。几何异构

解析：本题考查药物立体结构对药物效应的影响。反式己烯雌酚与雌二醇具有相同的生物活性，而顺式己烯雌酚没有此活性。产生这种差异的原因是几何异构（B对）。几何异构是由双键或环的刚性或半刚性系统导致分子内旋转受到限制而产生的。由于几何异构体结构差别较大，引起药物分子的药效基团和受体异构体的互补相差较大，生物活性往往有较大差别。己烯雌酚，其反式异构体与雌二醇骨架不同，但两个酚羟基排列的空间距离和雌二醇的两个羟基的距离近似，表现出与雌二醇相同的生理活性。抗精神病药氯普噻吨（泰尔登）顺式作用强于反式，原因在于顺式异构体的构象与多巴胺受体的底物多巴胺的优势构象相近，而反式异构体的构象则相差太远。构象异构（A错）是指具有一定构型的有机物分子由于碳、碳单键的旋转或扭曲（不是把键断开）而使得分子各原子或原子团在空间产生不同的排列方式的一种立体异构现象。构型异构（C错）是原子在大分子中不同空间排列所产生的异构现象。包括顺反异构、对映异构（也称为旋光异构）等。组成差异（D错）、代谢差异（E错）不属于立体结构。